不存在吸收过程，可以认为药物全部被机体利用的是
A. 静脉注射给药
B. 肺部给药
C. 阴道黏膜给药
D. 口腔黏膜给药
E. 肌内注射给药

正确答案：A。静脉注射给药

解析：本题考查注射给药的给药部位和吸收途径。静脉注射给药（A对）不存在吸收过程，可以认为药物全部被机体利用；肺部给药（B错）肺部吸收；阴道黏膜给药（C错）药物在阴道黏膜吸收；口腔黏膜给药（D错）口腔黏膜吸收进入血液循环；肌内注射（E错）药物经结缔组织扩散进入血液循环。